小儿重症肺炎出现严重腹胀，最可能的原因是
A. 低钙血症
B. 消化不良
C. 低钾血症
D. 低钠血症
E. 中毒性肠麻痹

正确答案：E。中毒性肠麻痹

解析：电解质紊乱多如低钙血症（A错）、低钾血症（C错）、低钠血症（D错）多见于小儿腹泻，很少见于小儿重症肺炎。小儿重症肺炎可以并发消化系统的症状，当出现严重腹胀时，是由中毒性肠麻痹所致（E对），虽然并发消化不良也可以出现腹胀，但仅仅一般的轻度腹胀，不会出现严重腹胀（B错）。